将苯二氮䓬结构中的苯环以电子等排体噻吩环置换，得到的抗焦虑药物是
A. 咪达唑仑
B. 奥沙西泮
C. 依替唑仑
D. 奥沙唑仑
E. 艾司唑仑

正确答案：C。依替唑仑

解析：本题考查镇静催眠药的结构改造。依替唑仑（C对）是将阿普唑仑分子中的苯核用5-乙基噻吩取代得到的，适用于治疗各种原因引起的焦虑、紧张、抑郁、失眠等疾病。